我国《局部振动卫生标准》中规定接触工具手柄或工件的4小时等能量频率计权加速度有效值不得超过
A. 2m/s²
B. 3m/s²
C. 5m/s²
D. 5cm/s²
E. 6cm/s²

正确答案：C。5m/s²

解析：本题考查《局部振动卫生标准》。使用振动工具或工件的作业，工具手柄或工件的四小时等能量频率计权振动加速度不得超过5m/s²（C对ABDE错）。